严重的腺垂体功能减退症易发生低血糖主要是缺乏
A. PRL及LH
B. PRL及TSH
C. PRL及ACTH
D. GH及TSH
E. GH及ACTH

正确答案：E。GH及ACTH

解析：垂体分为腺垂体和神经垂体，腺垂体合成和分泌的肽类和蛋白质激素共7种，即促甲状腺激素（TSH）、促肾上腺皮质激素（ACTH）、卵泡刺激素（FSH）、促黄体激素（LH）、生长激素（GH）、泌乳素（PRL）和黑色素细胞刺激素（MSH）。其中GH和ACTH（E对）与糖代谢有关，GH有直接升高血糖作用，ACTH通过促进糖皮质激素的分泌而升高血糖，因此当腺垂体功能减退时GH和ACTH（E对）分泌减少可引起低血糖。PRL及LH（AD错）均与性腺的分泌调节活动有关，而与血糖的调节无关。TSH（BC错）可促进消化吸收餐后血糖，亦可促进周围组织利用，降低血糖。